男婴，3天。不吃、不哭、反应差，肛温33度，双下肢皮肤硬肿，暂不能进食，需经静脉给予热量补充，初始量每日为
A. 40Kcal/Kg
B. 60Kcal/Kg
C. 80Kal/Kg
D. 50Kcal/Kg
E. 70Kcal/Kg

正确答案：D。50Kcal/Kg

解析：患儿，不吃不哭反应差体温低，并有双下肢皮肤硬肿的表现，应诊断为寒冷损伤综合征。补充热量是治疗寒冷损伤综合症的主要措施，静脉给予热量补充时，初始量应每日从50Kcal/Kg开始（D对）。